膀胱空虚时，膀胱尖位于
A. 耻骨联合上缘以上
B. 坐骨支平面
C. 耻骨联合上缘以下
D. 坐骨结节平面
E. 尾骨尖平面

正确答案：C。耻骨联合上缘以下

解析：膀胱空虚时全部位于盆腔内，故膀胱尖位于耻骨联合上缘以下（C对），充盈时膀胱腹膜返折线可上移至耻骨联合上方。